在突发环境污染事件中，泄漏物急性毒作用特别强，空气浓度达到致命、永久损害健康，或使人立即丧失逃生能力，这种浓度被定义为
A. 最高允许浓度
B. 最大阈值浓度
C. 半数致死浓度
D. 直接致害浓度
E. 间接致害浓度

正确答案：D。直接致害浓度

解析：本题考查直接致害浓度。在突发环境污染事件中，泄漏物急性毒作用特别强，空气浓度达到致命、永久损害健康，或使人立即丧失逃生能力，这种浓度被定义为直接致害浓度（D对ABCE错）。